患者，男，68岁，患高血压10年，2型糖尿病9年，陈旧性心肌梗死。长期服用二甲双胍片500mgtid、硝苯地平控释片30mgqd，目前血压160/90mmHg，心率90次/分钟，糖化血红蛋白6.3%，LDL-C3.0mmo/L，肝肾功能正常，为完善心脑血管疾病二级预防治疗，可加用的药物有
A. 辛伐他汀
B. 阿卡波糖
C. 替米沙坦
D. 阿司匹林
E. 美托洛尔

正确答案：A、C、D、E。辛伐他汀；替米沙坦；阿司匹林；美托洛尔

解析：本题考查心脑血管疾病二级预防治疗。为完善心脑血管疾病二级预防治疗，可加用的药物有辛伐他汀（A对）、替米沙坦（C对）、阿司匹林（D对）、美托洛尔（E对）。“ABCDE方案”对于指导冠心病二级预防有所帮助：“A”指阿司匹林和ACEI，“B”指β受体阻断剂和血压控制，“C”指控制胆固醇和戒烟，“D”指控制饮食和糖尿病，“E”指健康教育和运动。阿卡波糖（B错）为α-葡萄糖苷酶抑制剂，为单纯餐后血糖高的糖尿病患者首选。